下列哪一项属于人际和谐的表现
A. 乐于与人交往
B. 交往中保持独立而完整的人格
C. 能客观评价别人
D. 交往中积极态度多于消极态度
E. 以上都是

正确答案：E。以上都是

解析：人际和谐表现在：一是乐于与人交往，既有稳定而广泛的人际关系，又有知己的朋友；二是在交往中保持独立而完整的人格，有自知之明，不卑不亢；三是能客观评价别人，取人之长补己之短，宽以待人，友好相处，乐于助人；四是交往中积极态度多于消极态度。掌握“心理健康概述”知识点。